女，35岁，半年前母突然病故，此后失眠情绪低沉，不愿与人交往。近三个月来独处时常听见有声音对她讲话，说母亲病故与某人有关，故多次给公安机关写信反映母亲被害之事，后来又感到自己的思维情感不由自己支配，自己的想法还未说出已人人皆知，常独自哭泣。神经系统检查未见异常，有慢性肝炎病史3年，目前肝功ALT80U/L。该患者没有出现的症状是
A. 被害妄想
B. 强制性思维
C. 情感低落
D. 思维被洞悉妄想
E. 言语性幻听

正确答案：B。强制性思维

解析：失眠情绪低沉，常独处暗自哭泣（情感低落）（C对）。患者感到自己的思维情感不由自己支配，自己的想法还未说出已人人皆知（思维被洞悉妄想）（D对）。近三个月来独处时常听见有声音对她讲话（言语性幻听）（E对），说母亲病故与某人有关（被害妄想）（A对）。